下列各项，与气逆的发生有密切关系的是
A. 心、脾、肾
B. 心、肝、肾
C. 肺、肝、胃
D. 肺、脾、肾
E. 肝、胃、三焦

正确答案：C。肺、肝、胃

解析：五脏中与气关系最密切的是肺和肝，病理上也最易发生气逆的病症，分别为肺气上逆、肝气上逆；六腑中，由于胃经多气血，病理上也最易发生胃气上逆（C对）。